以下关于牙龈指数（GI）的描述中，错误的是
A. 只观察牙龈情况
B. 检查牙龈的颜色
C. 检查牙龈质地的改变
D. 检查牙龈出血倾向
E. 检查牙槽骨吸收情况

正确答案：E。检查牙槽骨吸收情况

解析：牙龈指数（GI）只观察牙龈情况，检查牙龈颜色和质地改变，以及出血倾向。掌握“牙周病流行病学及分级预防”知识点。